患者，男性，63岁。右侧下牙龈菜花状溃疡3个月，无唇麻木症状。活检为“鳞状细胞癌Ⅰ级”，检查见溃疡大小约3cm×2cm，颌面及颈部未及明显淋巴结肿大。对该患者首先要补充的检查是
A. CT
B. B超
C. 颌骨的X线片
D. 放射性核素骨扫描
E. PET

正确答案：C。颌骨的X线片

解析：根据题干的信息，患病部位发生在下牙龈部，颌骨X线片检查是最简单最经济的检查，且能给临床提供骨破坏范围及深度信息。掌握“鳞状细胞癌概述及舌癌、牙龈癌”知识点。